正常人尿中的主要色素
A. 胆红素
B. 胆色素
C. 胆绿素
D. 胆汁酸盐
E. 血红素

正确答案：B。胆色素

解析：正常人尿中的主要色素是尿胆素。胆色素包括胆红素（A错）、胆绿素（C错）、胆素原和胆素，所以本题最佳选项是B。胆汁酸盐（D错）是胆汁的主要成分，是胆固醇最主要的代谢产物。血红素（E错）存在于血液中，是血红蛋白的重要组成部分。